佝偻病活动期X线表现
A. 干骺端增厚，钙化带模糊或消失，呈毛刷样杯口状改变
B. 钙化带重新出现，致密增厚
C. 骨骼无明显改变
D. 长骨短曲和弯曲，干骺端变宽，呈喇叭口状，轮廓光整
E. 长骨钙化预备带密度增加，骨皮质增厚及骨硬化

正确答案：A。干骺端增厚，钙化带模糊或消失，呈毛刷样杯口状改变

解析：活动期X线检查干骺端临时钙化带模糊或消失，呈毛刷样，并有杯口状改变；骺软骨明显增宽，骨骺与干骺端距离加大；骨质普遍稀疏，密度减低，可有骨干弯曲或骨折。掌握“维生素D缺乏性佝偻病”知识点。